哺乳期妇女应慎用的药是
A. 午时茶颗粒
B. 参苏片
C. 荆防败毒丸
D. 柴胡口服液
E. 双黄连口服液

正确答案：A。午时茶颗粒